由国家制定或认同，并以强制力保证实施的保障人体健康的法律规范的总和是指
A. 法律的渊源
B. 法律的规范
C. 卫生法律
D. 卫生法规
E. 卫生法

正确答案：E。卫生法

解析：由国家制定或认同，并以强制力保证实施的保障人体健康的法律规范的总和是指卫生法。卫生法是调整卫生社会关系的法律规范的总称（E对CD错）。法律渊源即法律的来源，是指国家机关、公民和社会组织为寻求行为的根据而获得具体法律的来源（A错）。法律规范，是指国家制定或认可，反映统治阶级意志，并由国家强制力保证实现的一种社会规范（B错）。